治疗经间期出血肾阴虚证，应选
A. 清肝止淋汤
B. 左归丸
C. 两地汤合二至丸
D. 逐瘀止血汤
E. 调肝汤

正确答案：C。两地汤合二至丸

解析：经间期出血肾阴虚证宜滋肾养阴，固冲止血，两地汤的功效为滋阴壮水，二至丸的功效为滋养肝肾止血，为经间期出血肾阴虚证之首选（C对）。清肝止淋汤的功效为清利湿热，固冲止血，用以治疗经间期出血之湿热证（A错）。左归丸的功效为滋阴补肾，填精益髓，用以治疗崩漏之肾阴虚证（B错）。逐瘀止血汤的功效为活血化瘀，固冲止血，用于治疗崩漏之血瘀证（D错）。调肝汤的功效为补益肾气，平调肝气，用以治疗痛经之肾气亏虚（E错）。